广藿香的功效是
A. 截疟
B. 行气
C. 温中
D. 解暑
E. 消积

正确答案：D。解暑

解析：本题考查的是广藿香的功效。广藿香的功效是解暑（D对）。广藿香：【功效】化湿，止呕，发表解暑。草果：【功效】燥湿温中（C错），除痰截（A错）疟。厚朴：【功效】燥湿，行气（B错），消积（E错），平喘。